不可逆竞争性β-内酰胺酶抑制药物是
A. 氨苄西林
B. 舒巴坦钠
C. 头孢氨苄
D. 亚胺培南
E. 氨曲南

正确答案：B。舒巴坦钠

解析：本题考查舒巴坦钠。舒巴坦钠（B对）含有β-内酰胺环，并且对酶的亲和力很强，在被β-内酰胺酶水解的同时，不可逆地与酶结合，抑制β-内酰胺酶的作用。氨苄西林（A错）属于青霉素类抗生素药物，通过干扰敏感细菌细胞壁黏肽的合成使细菌失去细胞壁的屏障作用，在自溶酶的作用下裂解死亡。头孢氨苄（C错）属于第一代头孢菌素类抗菌药物，临床用于金黄色葡萄球菌、溶血性链球菌、肺炎球菌、流感杆菌、痢疾杆菌等敏感菌株所致的轻、中度感染。亚胺培南（D错）是碳青霉烯类抗菌药物，对PBPs亲和力强，具有抗菌谱广、抗菌作用强以及耐酶的特点。氨曲南（E错）属于单环β-内酰胺类抗生素，对G⁻有强大抗菌作用。